原发性第二鳃裂瘘外口一般多位于
A. 耳垂周围
B. 下颌角处
C. 颈中、下1/3，胸锁乳突肌前缘处
D. 颈中、上1/3、胸锁乳突肌前缘处
E. 胸锁乳突肌前缘下1/3处

正确答案：D。颈中、上1/3、胸锁乳突肌前缘处

解析：本题考查甲状舌管囊肿及鳃裂囊肿。原发性第二鳃裂瘘外口一般多位于颈中、上1/3，胸锁乳突肌前缘处（D对）。（先以最新本科教材为主）